治疗军团菌所致肺炎的首选药物是
A. 庆大霉素
B. 多西环素
C. 红霉素
D. 链霉素
E. 妥布霉素

正确答案：C。红霉素

解析：本题考查大环内酯类抗生素。治疗军团菌所致肺炎的首选药物是红霉素（C对）。红霉素对G⁺菌的金黄色葡萄球菌（包括耐药菌）、表皮葡萄球菌、链球菌等抗菌作用强，对部分G⁻菌如脑膜炎奈瑟菌、淋病奈瑟菌、流感杆菌、百日咳鲍特菌、布鲁斯菌、军团菌等高度敏感。庆大霉素（A错）用于G-细菌所致的败血症。多西环素（B错）用于细菌、立克次氏体、支原体、衣原体引起的感染。链霉素（D错）主要与其他抗结核药联合，用于结核分枝杆菌所致各种结核病的初治病例，或其他敏感分枝杆菌感染。妥布霉素（E错）与庆大霉素相同，主要用于各种严重的革兰阴性杆菌感染，但一般不作为首选药。